具有高溶解度、高渗透性，只要处方中没有显著影响药物吸收的辅料，通常口服时无生物利用度问题的药物是
A. 其他类药物
B. 生物药剂学分类系统（BCS）Ⅰ类药物
C. 生物药剂学分类系统（BCS）Ⅳ类药物
D. 生物药剂学分类系统（BCS）Ⅲ类药物
E. 生物药剂学分类系统（BCS）Ⅱ类药物

正确答案：B。生物药剂学分类系统（BCS）Ⅰ类药物

解析：本题考查生物药剂学分类。具有高溶解度、高渗透性，只要处方中没有显著影响药物吸收的辅料，通常口服时无生物利用度问题的药物是生物药剂学分类系统(BCS）Ⅰ类药物（B对）。生物药剂学分类系统根据药物溶解性和肠壁渗透性的不同组合将药物分为四类（A错）：（1）生物药剂学分类系统Ⅰ类药物具有高溶解度、高渗透性，其体内吸收取决于溶出度。（2）生物药剂学分类系统Ⅱ类药物（E错）具有低溶解度、高渗透性，其体内吸收量取决于溶解度，通过增加溶解度和溶出速度的方法，改善药物的吸收。（3）生物药剂学分类系统Ⅲ类药物（D错）具有高溶解度、低渗透性，跨膜转运是药物吸收的限速过程。通过增加药物的脂溶性来改善药物的渗透性，或选用渗透促进剂及合适的微粒给药系统增加药物的吸收。（4）生物药剂学分类系统IV类药物（C错）具有低溶解度、低渗透性，其体内吸收比较困难，采用微粒给药系统靶向给药，或制备前体药物改善药物溶解度或（和）渗透性。